山楂主归
A. 肺经
B. 肝经
C. 肾经
D. 脾经
E. 胃经

正确答案：B、D、E。肝经；脾经；胃经

解析：本题考查的是山楂的性味归经。山楂主归肝经（B对）、脾经（D对）与胃经（E对）。山楂：【性味归经】酸、甘，微温。归脾、胃、肝经。肺（A错）、肾（C错）经为白果的归经。白果：【性味归经】甘、苦、涩，平。有毒。归肺、肾经。